上提并使下颌骨向对侧移动
A. 颞肌
B. 咬肌
C. 翼内肌
D. 翼外肌
E. 颊肌

正确答案：D。翼外肌

解析：颞肌（A错）、咬肌（B错）和翼内肌（C错）上提下颌骨（闭口），并使下颌骨向前或向后运动。翼外肌（D对）两侧同时收缩作张口运动（上提下颌骨），一侧收缩使下颌移向对侧。颊肌（E错）使唇、颊贴紧牙齿，帮助咀嚼和吸吮，牵拉口角向外侧。